获得性膜是指
A. 牙萌出时牙面上胚胎来源的有机物
B. 牙面上积累的食物残渣沉积物
C. 吸附至牙面的唾液蛋白或糖蛋白
D. 均匀分布于牙面上的微生物层
E. 在菌斑作用下由菌斑微生物所分泌的蛋白膜

正确答案：C。吸附至牙面的唾液蛋白或糖蛋白

解析：本题考查龋病概述。唾液蛋白或糖蛋白吸附至牙面所形成的生物膜（C对）称为获得性膜。可人为的分成两层：外层为表面层，其下方为表面下膜。